下列具有凉血解毒功效的药物是
A. 大黄
B. 芒硝
C. 芦荟
D. 火麻仁
E. 桃仁

正确答案：A。大黄

解析：大黄的功效是泻下攻积，清热泻火，凉血解毒，逐瘀通经，利湿退黄（A对）。芒硝（B错）的功效是泻下通便，润燥软坚，清火消肿。芦荟（C错）的功效是泻下通便，清肝泻火，杀虫疗疳。火麻仁（D错）的功效是润肠通便。桃仁（E错）的功效是活血祛瘀，润肠通便，止咳平喘。